不利于医院整体效应发挥的是群体间的
A. 互补
B. 师承
C. 控制
D. 离心
E. 合作

正确答案：D。离心